男性，64岁，上颌：54321|12367，下颌：8765|45678缺失，可摘局部义齿修复。戴牙咬下唇。其原因是
A. 义齿松动
B. 前牙覆盖过小
C. 前牙开（牙合）
D. 垂直距离过低
E. 垂直距离过高

正确答案：B。前牙覆盖过小

解析：本题考查局部义齿修复后出现的问题及处理。咬唇的最常见的原因是由于人工上前牙与下前牙的覆盖过小（B对），而其他几个选项的情况均不会导致咬下唇。